患者，女，38岁，右上尖牙有瘘管，经根管治疗后，可以开始修复治疗的时间是
A. 3天后
B. 一周后
C. 两周后
D. 一个月后
E. 瘘管自行闭合后

正确答案：E。瘘管自行闭合后

解析：本题考查桩核冠。必须等瘘管完全封闭后（E对）再进行桩冠修复。